28岁初产妇，妊娠39周，枕右前位。阵发性腹痛9小时，宫缩9分钟一次，持续35秒，宫口开大2cm。此时处理原则应是
A. 人工破膜
B. 肌注哌替啶100mg
C. 肌注麦角新碱
D. 静脉滴注缩宫素
E. 立即行剖宫产术

正确答案：B。肌注哌替啶100mg

解析：青年初产妇，宫口开大2cm，经历9小时（＜16小时），说明处于潜伏期（潜伏期指从宫口开始扩张至扩张3cm，需8小时，最大时限16小时），宫缩9分钟一次（＞5～6分钟），持续35秒（＞30秒），故最可能的原因是子宫收缩节律异常引起的非协调性子宫收缩乏力。人工破膜（P189）（A错）适用于宫口扩张≥3cm、无头盆不称、胎头已衔接而产程延缓者。肌注哌替啶100mg（B对）主要用于不协调性宫缩乏力的治疗。肌注麦角新碱（C错）用于产后子宫出血、产后子宫复旧不全。静脉滴注缩宫素（P189）（D错）主要用于协调性宫缩乏力、宫口扩张≥3cm、胎心良好、胎位正常、头盆相称者。立即行剖宫产（E错）适用于不能经阴道分娩或出现胎儿窘迫的产妇。